患者，女，56岁，血清总胆固醇和低密度脂蛋白胆固醇异常，初诊医师建议首先改变生活方式（控制饮食，增强运动）。一个月后复查血脂水平仍未达标，医师处方辛伐他汀片20mg/d治疗。该患者服用辛伐他汀片的适宜时间是
A. 早上
B. 上午
C. 中午
D. 下午
E. 晚上

正确答案：E。晚上

解析：本题考查辛伐他汀的使用。该患者服用辛伐他汀片的适宜时间是晚上（E对）。辛伐他汀用于高胆固醇血症，初始剂量一次10～20mg，晚间顿服。